急性细菌性痢疾典型的大便性状是
A. 黏液脓血便
B. 柏油便
C. 米泔样便
D. 蛋花汤样便
E. 血水样便

正确答案：A。黏液脓血便

解析：菌痢的主要病变位于结肠，以乙状结肠和直肠最显著。急性菌痢的基本病理变化为弥漫性纤维蛋白渗出性炎症，肠黏膜表面覆盖大量黏液、脓血性渗出物。其典型的大便性状为黏液脓血便（A对）。柏油样便（B错），尤其伴有呕血时，是上消化道出血的典型表现。米泔样便（C错）为霍乱的典型大便性状。病毒性肠炎或致病性大肠杆菌肠炎可使大便呈蛋花汤样改变（D错）。血水样便（E错）多见于痔疮。